6～7个月婴儿应会的动作是
A. 用筷子
B. 快跑
C. 独坐
D. 独走
E. 双脚跳

正确答案：C。独坐

解析：一般小儿3个月抬头较稳，6个月时能双手向前撑住独坐（C对），8～9个月可用双上肢向前爬，1岁能走，2岁会跳，3岁才能快跑。细动作：是指手指的精细动作。新生儿两手紧握拳，生后3个月能有意识地握物，3～4个月能玩弄手中物体，6～7个月时出现换手、捏与敲等探索性动作，9～10个月能用拇指取细小物品，12～15个月时能用匙取食、乱涂画，2～3岁会用筷子，4岁能自己穿衣，绘画及书写。用筷子（A错）见于2～3岁。快跑（B错）见于3岁。独走（D错）见于1岁。双脚跳（E错）见于2岁。